初产妇，26岁。临产6小时胎头未进入骨盆入口。此时测量骨盆最有价值的径线为
A. 对角径
B. 出口横径
C. 坐骨结节间径
D. 出口后矢状径
E. 中骨盆前后径

正确答案：A。对角径

解析：初产妇，26岁。临产6小时胎头未进入骨盆入口（一般情况下初产妇在预产期前1～2周胎头已衔接，骨盆入口平面狭窄时，胎头衔接常受阻）。根据本例临床表现，考虑骨盆入口平面狭窄的诊断。骨盆入口平面狭窄以骨盆入口平面前后径狭窄为主，但是骨盆入口前后径无法直接测量，一般测量对角径（为骶岬上缘中点到耻骨联合下缘的距离，正常值为12.5～13㎝），此值减去1.5～2㎝为骨盆入口前后径的长度，故此时测量骨盆最有价值的径线为对角径（A对）。出口横径（又称坐骨结节间径，孕妇取仰卧位，两腿向腹部弯曲，双手抱双膝，测量两坐骨结节内侧缘的距离，正常值为8.5～9.5㎝）（B错）主要用于骨盆出口平面狭窄的诊断（P192）。坐骨结节间径（或称出口横径）（C错）、出口后矢状径（为坐骨结节间径中点至骶骨尖端的长度，正常值为8～9㎝）（D错）及中骨盆前后径（E错）（为耻骨联合下缘中点通过两侧坐骨棘连线中点至骶骨下端间的距离，平均值约为11.5cm）主要用于中骨盆平面狭窄的诊断（P192）。